28岁妇女，孕35周，G1P0，合并妊娠期高血压综合征，需终止妊娠，下列哪项提示胎儿未成熟
A. 羊水卵磷脂与鞘磷脂比值（L/S）>2
B. 测胎头双顶径值>8.5cm
C. 羊水中脂肪细胞出现率达20%
D. 肌酐测定>176.8μmol/L
E. 羊水胆红素类物质测值>0.02

正确答案：E。羊水胆红素类物质测值>0.02

解析：羊水胆红素检查可以反映胎儿在宫内的生长情况、成熟程度、以及帮助鉴别胎儿溶血性疾病的诊断，分光光度计测定法结果判断A450：①<0.02，提示胎肝成熟。②0.02～0.04，为胎肝成熟可疑（E对）。③>0.04，为胎肝未成熟。羊水卵磷脂与鞘磷脂比值如下：L/S>2：肺成熟、胎儿不出现急性呼吸窘迫综合征（A错），L/S<1.5：肺不成熟，相当多的胎儿出现急性呼吸窘迫综合征，L/S1.5-1.9：中间型，少数胎儿发生急性呼吸窘迫综合征。一般超声检查胎儿双顶径大于8.5厘米（B错）时，提示胎儿属于成熟了。羊水中脂肪细胞出现率：>20%则认为胎儿皮肤已经成熟（C错）；10%～20%为临界值；<10%则认为胎儿皮肤不成熟；>50%表示过期妊娠。孕妇肌酐正常值70-108umol/L，怀孕的人都会出现肌酐值偏高的，由于本题患者妊娠期高血压，故肌酐上升（D错）。